单纯性高血压，无其他并发症，血压如高于多少时应先进行治疗
A. 150/80mmHg
B. 160/95mmHg
C. 170/95mmHg
D. 180/100mmHg
E. 190/110mmHg

正确答案：D。180/100mmHg

解析：单纯性高血压，无其他并发症，如脑、心、肾器质性损害，一般是可以拔牙的。血压如高于180/100mmHg时应先进行治疗。在注意血压值的同时，还应注意患者的自觉症状、既往血压最高值和近期血压波动情况。掌握“牙拔除的适应证与禁忌证”知识点。